化生“天癸”的物质基础是
A. 肝血
B. 肾精
C. 脾气
D. 肺阴
E. 心血

正确答案：B。肾精

解析：机体生殖器官的发育，性功能的成熟与维持，以及生殖能力等，同样取决于肾中精气的盛衰。出生之后，由于肾精及肾气的不断充盈，天癸随之产生。天癸，是肾精充盈而化生的促进生殖器官成熟（B对），维持生殖功能的精微物质。肝血可以濡养肝脏本身，还输布至其形体官窍，濡养筋、爪、目等，维持其正常的功能（A错）。脾气在维持气机升降方面具有重要作用，脾气宜上升为主，以升为健（C错）。肺气肃降与宣发协调，有赖于肺阴与肺阳的协调。肺阴主凉润、肃降，肺阴不足，凉润、肃降不及，易导致虚热虚火内生、咳喘气逆的病变（D错）。心血充盛，表明心主血脉功能正常，可见心胸舒畅，面色红润有光泽，舌质淡红，脉和缓有力；心血亏虚，则心悸心烦，面色淡白，舌质淡，脉细弱无力（E错）。